肺结核的主要传染源是
A. 被污染的水源
B. 含人型结核分枝杆菌的牛乳
C. 痰涂片阳性的肺结核患者
D. 患有结核病的动物
E. 健康带菌者

正确答案：C。痰涂片阳性的肺结核患者